关于胃食管反流病治疗方案的说法，错误的是
A. 存在夜间酸突破时，可以加用法莫替丁20mgbid
B. 一种PPI无效时，可以换用另一种PPI
C. 标准剂量PPI无效时，可改为2倍标准剂量
D. PPI单用疗效不佳时，可以加用莫沙必利
E. 存在胆汁反流时，可以加用铝碳酸镁咀嚼片

正确答案：A。存在夜间酸突破时，可以加用法莫替丁20mgbid

解析：本题考查胃食管反流病治疗方案。存在夜间酸突破时，可以加用法莫替丁睡前服用，每日一次（A错，为本题正确答案）。PPI可产生显著而持久的抑酸效果，是GERD治疗的首选药物。单剂量PPI治疗无效可改用双倍剂量（C对），一种PPI无效可尝试换用另一种PPI（B对）。当抑酸药物治疗GERD效果不佳时，可考虑联合应用促动力药物（D对），特别是对于伴有胃排空延迟的患者。存在胆汁反流时，可以加用铝碳酸镁咀嚼片（E对）。